街头烤羊肉串是将小块羊肉穿在铁钎上，直接在炭火上烤制，这种羊肉串中含量较高的有
A. N-亚硝酰胺
B. 苯并（a）芘
C. 氯丙烷
D. 丙烯酰胺
E. 二恶英

正确答案：B。苯并（a）芘